某单位发生了症状以呕吐为主，腹泻为次的食物中毒，防疫站检查食品等未培养出肠道致病菌，而在炊事员手上查出了化脓感染灶，试问致病菌可能是哪种
A. 鼠伤寒沙门菌
B. 产气荚膜梭菌
C. 金黄色葡萄球菌
D. 肠炎杆菌
E. 副溶血弧菌

正确答案：C。金黄色葡萄球菌

解析：炊事员手上查出了化脓感染灶，皮肤的化脓性感染，致病菌多为金黄色葡萄球菌。金黄色葡萄球菌肠炎是金黄色葡萄球菌引起的，多因原发疾病长期用抗生素引起肠道菌群失调所致，抗生素敏感菌株受到抑制，耐药的金黄色葡萄球菌株趁机繁殖。金黄色葡萄球菌为侵袭性细菌，能产生毒素，对肠道破坏性大，所以金黄色葡萄球菌肠炎起病急，中毒症状严重，主要表现为呕吐、发热、腹泻。呕吐常在发热前出现，发热很高。轻症大便次数稍多，为黄绿色糊状便；重症大便次数频数，每日可达数十次，大便呈暗绿色水样便，外观像海水，所以叫海水样便。黏液多，有腥臭味，有时可排出片状伪膜，将伪膜放入生理水，脱落的肠黏膜即漂在水面上，对诊断帮助很大。体液损失多，患儿脱水、电解质紊乱和酸中毒严重，可发生休克。挑选大便黏液部分涂片，在显微镜下检查可见大量脓细胞，如经革兰氏染色，显微镜检查可见成堆的大量革兰氏阳性球菌。大便培养金黄色葡萄球菌生长，即可明确诊断。掌握“葡萄球菌属”知识点。